梗死灶呈地图状改变的脏器是
A. 肺
B. 脑
C. 肾
D. 肠
E. 心

正确答案：E。心

解析：梗死灶呈地图状改变的脏器是心（E对），是由于心冠状动脉分支不规则，故梗死灶的形状也不规则。肺（A错）、肾（C错）的梗死灶呈锥形。脑（B错）的梗死灶无特殊形状（P59），往往经坏死、变软、液化后形成囊状或被星形胶质细胞和胶质纤维替代，形成胶质瘢痕。肠（D错）的梗死灶呈节段形。